单纯疱疹病毒可经下列途径传播，除了
A. 皮肤
B. 角膜
C. 黏膜
D. 消化道
E. 呼吸道

正确答案：D。消化道

解析：本题考查单纯疱疹病毒的传播途径。单纯疱疹病毒不会经消化道传播（D错，为本题的正确答案），因为单纯疱疹病毒主要直接接触累及皮肤黏膜，一般不会通过消化道感染致病。单纯疱疹病毒是单纯疱疹的致病病毒，主要引起皮肤黏膜病损，表现为簇集状小水疱，有自限性，易复发。单纯疱疹病毒主要通过飞沫唾液及疱疹液传播也可以通过食具和衣物间接传染。传染方式主要为直接经呼吸道（E对）、口腔、鼻、眼结膜（B对）、生殖器黏膜（C对）或破损皮肤（A对）进入人体。